卫气营血辨证与三焦辨证常用于治疗的是
A. 心理性疾病
B. 肠寄生虫病
C. 营养性疾病
D. 急性传染病
E. 结缔组织病

正确答案：D。急性传染病

解析：温病即热性病，大多属于传染性疾病的范围，以发病急，进展快，变化多为特点，这类疾病的辨证论治，是在《伤寒论》六经辨证的基础上，根据病情发展的规律，运用三焦辨证和卫气营血辨证（D对）。